适用于绿脓杆菌感染的药物是
A. 红霉素
B. 庆大霉素
C. 氯霉素
D. 林可霉素
E. 利福平

正确答案：B。庆大霉素

解析：本题考查绿脓杆菌感染的药物。庆大霉素（B对）主要用于敏感革兰阴性杆菌所致的严重感染。红霉素（A错）主要用于青霉素过敏患者的替代用药。氯霉素（C错）常用于需氧菌和厌氧菌混合感染、严重厌氧菌感染以及立克次体感染等。林可霉素（D错）用于抵抗敏感葡萄球菌属、链球菌属及厌氧菌所致的疾病。利福平（E错）用于抗结核病。